按照给药途径不同，缓释制剂的类型有
A. 口服缓释制剂
B. 眼用缓释制剂
C. 口腔用缓释制剂
D. 牙用缓释制剂
E. 透皮缓释制剂

正确答案：A、B、C、D、E。口服缓释制剂；眼用缓释制剂；口腔用缓释制剂；牙用缓释制剂；透皮缓释制剂

解析：本题考查的是缓释制剂的类型。按照给药途径不同，缓释制剂的类型有口服缓释制剂（A对）、眼用缓释制剂（B对）、口腔用缓释制剂（C对）、牙用缓释制剂（D对）、透皮缓释制剂（E对）。缓释、控释制剂的类型主要有以口服给药为主的缓释、控释制剂，同时也包括眼用、鼻腔、耳道、阴道、直肠、口腔或牙用、透皮或皮下、肌内注射及皮下植入等缓释、控释制剂。